皂苷易溶于
A. 热甲醇
B. 丙酮
C. 乙醚
D. 乙酸乙酯
E. 三氯甲烷

正确答案：A。热甲醇

解析：本题考查的是皂苷的溶解度。皂苷易溶于热甲醇（A对）。皂苷溶解度：大多数皂苷极性较大，易溶于水、热甲醇和乙醇等极性较大的溶剂，难溶于丙酮（B错）、乙醚（C错）等有机溶剂。皂苷在含水正丁醇中有较大的溶解度，因此正丁醇常作为提取皂苷的溶剂。次级苷由于糖数目的减少极性降低，在水中溶解度减少，易溶于乙醇、丙酮、乙酸乙酯（D错）等。皂苷元则难溶于水而易溶于石油醚、苯、乙醚、三氯甲烷（E错）等低极性溶剂。皂苷有助溶性能，可促进其他成分在水中的溶解。